某校住校生郑某感到不适，几天后确诊为病毒性肝炎。校保健室初步诊治，便安排其去市医院住院治疗，并未引起注意。过了几天后，又有郑某的同学、班主任教师、军训的军官相继发病。保健室的负责人及班主任老师为此受到学校的严厉批评。对于郑某应当
A. 强制隔离治疗
B. 在指定的场所进行医学观察
C. 采取必要的治疗和控制措施
D. 采取必要的预防和控制措施
E. 在指定场所进行隔离治疗

正确答案：C。采取必要的治疗和控制措施